影响胆固醇吸收的药物是
A. 考来烯胺
B. 烟酸
C. 多烯脂肪酸
D. 低分子量肝素
E. 普罗布考

正确答案：A。考来烯胺